连续回流提取法与回流提取法比较，其优越性是
A. 节省时间且效率高
B. 节省溶剂且效率高
C. 受热时间短
D. 提取装置简单
E. 提取量较大

正确答案：B。节省溶剂且效率高

解析：本题考查的是中药化学成分的提取方式的特点。连续回流提取法与回流提取法比较，其优越性是节省溶剂且效率高（B对）。连续回流提取法：本法弥补了回流提取法中溶剂消耗量大，操作麻烦的不足，实验室常用索氏提取器来完成本法操作、但此法耗时较长（AD错）。回流提取法：是用易挥发的有机溶剂加热回流提取中药成分的方法。但对热不稳定的成分不宜用此法，且溶剂消耗量大，操作麻烦。